结脉与代脉的主要区别在于
A. 节律不同
B. 至数不同
C. 脉力不同
D. 脉位不同
E. 流利度不同

正确答案：A。节律不同

解析：结脉、代脉和促脉都属有歇止的脉象。其中，结脉为脉来迟而时一止，止无定数；代脉为脉来迟而中止，止有定数；促脉为脉来数而时一止，止无定数。故结脉与代脉的主要区别在于节律不同（A对）。